单纯二尖瓣狭窄患者可有
A. 左房扩大，右房缩小
B. 右房扩大，左房缩小
C. 右室缩小，左房扩大
D. 左室缩小或正常，左房扩大
E. 左房扩大，左室扩大

正确答案：D。左室缩小或正常，左房扩大

解析：单纯性二尖瓣狭窄时，舒张期从左心房流向左心室的血液受阻，淤积在左心房内，心房内压增高，导致左心房代偿性扩大（B错）。后期，随着左心房的压力愈来愈高，肺静脉回流受阻，可引起肺淤血和肺动脉高压，长期的肺动脉高压，可导致右心室代偿性肥大（C错），继而失代偿，右心室扩张致使三尖瓣相对关闭不全，右心室的血液将反流入右心房，并最终引起右心房扩大（A错）和体循环静脉淤血。左心室早期无明显变化，后期可因流入的血流减少，导致废用性萎缩（E错）。综上所述，单纯二尖瓣狭窄患者可有左室缩小或正常，左房扩大（D对）。